中国药典（2000年版）规定“室温”系指
A. 10℃
B. 20℃
C. 25℃
D. 20～30℃
E. 10～30℃

正确答案：E。10～30℃